属于阳离子型表面活性剂，可用于治疗咽喉炎的药物是
A. 氨溴索
B. 羟甲唑啉
C. 度米芬
D. 西地碘
E. 左卡巴斯汀

正确答案：C。度米芬

解析：本题考查度米芬。属于阳离子型表面活性剂，可用于治疗咽喉炎的药物是度米芬（C对）。氨溴索（A错）为多糖纤维素分解剂，用于痰液黏稠不宜咳出者。羟甲唑啉（B错）是α受体激动剂，用于鼻炎或鼻塞。西地碘（D错）适用于慢性咽炎、复发性口腔溃疡或者糜烂型扁平苔藓。左卡巴斯汀（E错）为H₁受体阻断剂，可用于治疗季节性过敏性鼻炎。